吗啡的适应证是
A. 感染性腹泻
B. 分娩止癌
C. 心源性哮喘
D. 颅脑外伤止癌
E. 支气管哮喘

正确答案：C。心源性哮喘